对污染较重的伤口清创后暂不缝合，观察2～3天后如无明显感染，再缝合。这种缝合为
A. 一期缝合
B. 二期缝合
C. 延期缝合
D. 减张缝合
E. 以上都不是

正确答案：C。延期缝合

解析：开放性创伤早期为污染伤口可行清创术，延期缝合。掌握“创伤和战伤”知识点。